“益火之源，以消阴翳”适用于：
A. 阳虚则寒之证
B. 阴虚则热之证
C. 阴盛则寒之证
D. 阴损及阳之证
E. 阳损及阴之证

正确答案：A。阳虚则寒之证

解析：阳虚则寒证即虚寒证，应用补阳的方法治疗，即“阴病治阳”或“益火之源，以消阴翳”（A对）。对“阴虚则热”所出现的虚热证，治宜滋阴以抑阳，即“阳病治阴”或“壮水之主，以制阳光”（B错）。对“阴胜则寒”所致的实寒证，宜用温热药物以消解其偏盛之阴寒，此即“寒者热之”之法（C错）。阴损及阳者，以阴虚为主，应在滋阴的基础上辅以补阳之品（D错）；阳损及阴者，以阳虚为主，应在补阳的基础上辅以滋阴之品（E错）。